一般来说要要求W/O型乳剂型软膏基质的pH值不大于
A. 7
B. 7.5
C. 8
D. 8.5
E. 6.5

正确答案：C。8